患者，女性，40岁。有风湿性关节炎病史10年，近5年出现呼吸困难、咳嗽和咯血等症状，并有肝大、腹水、双下肢水肿。查体：心尖区可闻及隆隆样舒张期杂音。心电图示右室大。此患者可能诊断为
A. 风心病主动脉瓣关闭不全
B. 肥厚型心肌病
C. 先天性心脏病
D. 风心病二尖瓣狭窄
E. 冠心病

正确答案：D。风心病二尖瓣狭窄

解析：该患者有风湿性关节炎病史10年，近5年出现呼吸困难、咳嗽和咯血等症状（左心衰表现），并有肝大、腹水、双下肢水肿（右心衰表现）。 查体:心尖区可闻及隆隆样舒张期杂音（二尖瓣狭窄特征性杂音），心电图示右室大。综合该患者临床表现和二尖瓣狭窄特征性杂音可诊断为风心病二尖瓣狭窄（D对）。风心病主动脉瓣关闭不全（P299）（A错）主要临床表现：随返流量增大，出现与心搏量有关的症状，如心悸、心前区不适、头颈部强烈动脉波动感等。主动脉瓣区可闻及一高调递减型叹气样杂音。肥厚性心肌病（P266）（B错）主要临床表现为：流出道梗阻患者可于胸骨左缘第3～4肋间闻及较粗糙的喷射性收缩期杂音。冠心病（P230）（E错）主要临床表现为胸骨中下段压榨性疼痛，常放射至左肩、左臂内侧达无名指和小指，或至颈、咽或下颌部。